下列哪项不是临床上常用的实验室检测HIV的微生物学检查方法
A. HIV-1抗体检测
B. 病毒载量检测
C. 外周血CD4+T细胞数量测定
D. HIV基因型耐药检测
E. 中和试验

正确答案：E。中和试验

解析：临床上常用的实验室检测HIV感染指标，主要用于AIDS或HIV感染者的诊断并指导用药，其中包括：HIV-1抗体检测；病毒载量测定；外周血CD4+T细胞数量测定；HIV基因型耐药检测。掌握“人类免疫缺陷病毒”知识点。